鉴别苯巴比妥依据的反应是
A. 芳香第一胺的反应
B. 丙二酰脲的反应
C. 绿奎宁反应
D. 托烷生物碱的反应
E. 与二氯靛酚钠的反应

正确答案：B。丙二酰脲的反应

解析：本题考查苯巴比妥的鉴别。鉴别苯巴比妥依据的反应是丙二酰脲反应（B对）。丙二酰脲类鉴别反应是巴比妥类药物母核的反应，包括银盐反应和铜盐反应。